恒牙迟萌的原因，不包括
A. 乳牙根尖病变，导致牙槽骨吸收
B. 乳牙早失，导致牙龈咀嚼增厚
C. 多生牙，牙瘤存在
D. 间隙丧失，萌出困难
E. 恒牙牙根发育异常

正确答案：A。乳牙根尖病变，导致牙槽骨吸收

解析：本题考查迟萌、多生牙和融合牙。乳牙根尖病变，导致牙槽骨吸收（A错，为本题正确答案）是乳牙早失的原因。恒牙迟萌：①局部因素和乳牙病变、早失、滞留有关。最常见上颌中切牙萌出迟缓。可能由于上颌乳切牙过早脱落，儿童习惯牙龈咀嚼，使局部牙龈角化增生，坚韧肥厚（B对），使牙齿萌出困难。额外牙、牙瘤和囊肿的阻碍（C对），恒牙发育异常如牙根弯曲（E对）。乳磨牙、乳尖牙早失等各种原因造成间隙缩窄导致恒牙萌出困难而迟萌（D对）。②全身因素：颅骨锁骨发育不全、先天性甲状腺分泌减少症等。③治疗、拍X线牙片确定有无恒牙。手术切除坚韧的牙龈。拔除额外牙，摘除牙瘤。治疗全身病。